有关胸骨的描述何者是错的
A. 胸骨可分为柄、体和剑突三部分
B. 胸骨柄上缘中份有颈静脉切迹
C. 柄和体相接处微向前突形成胸骨角
D. 胸骨角向后平对第2胸椎
E. 胸骨柄的侧缘接第1肋

正确答案：D。胸骨角向后平对第2胸椎

解析：胸骨可分柄、体和剑突 三部分（A对） ，胸骨柄上缘中份为颈静脉切迹（B对），柄外侧缘上份接第 1 肋软骨（E对），柄与体连接处微向前突，称胸骨角（C对），胸骨角向后平对第 4 胸椎体下缘（D错，为本题正确答案）。